黑膏药制备时，麝香、冰片等细料药的加入工序应是
A. 药料提取（“炸料”）
B. 炼油
C. 下丹成膏
D. 去“火毒”
E. 摊涂

正确答案：E。摊涂